关于流行病学，下列说法正确的是
A. 从个体的角度研究疾病和健康状况分布及其影响因素
B. 侧重研究传染病的流行特征和防治措施
C. 研究人群中疾病和健康状况分布及其影响因素
D. 只研究疾病的防治措施
E. 侧重研究慢性病的危险因素

正确答案：C。研究人群中疾病和健康状况分布及其影响因素

解析：流行病学研究的对象是人群，流行病学关注的事件包括疾病与健康状况（C对）。预防医学的研究内容包括研究慢性病的危险因素（E错）和研究疾病的防治措施（D错）。从个体的角度研究疾病和健康状况分布及影响因素是指临床医学（A错）。传染病学侧重研究传染病的流行特征和防治措施（B错）（P14）。